可在碱性条件下开环，再与盐酸羟胺缩合成异羟肟酸，并与三价铁离子络合成异羟肟酸铁的是
A. 香豆素
B. 蒽醌
C. 黄酮
D. 皂苷
E. 生物碱

正确答案：A。香豆素

解析：本题考查的是香豆素的显色反应。可在碱性条件下开环，再与盐酸羟胺缩合成异羟肟酸，并与三价铁离子络合成异羟肟酸铁的是香豆素（A对）。香豆素的异羟肟酸铁反应：由于香豆素类具有内酯环，在碱性条件下可开环，与盐酸羟胺缩合成异羟肟酸，然后再在酸性条件下与三价铁离子络合成盐显红色。蒽醌（B错）能发生显色反应，可用于鉴别。蒽醌的显色反应有Feigl反应、Bornträger's反应、与金属离子反应等。黄酮（C错）能发生显色反应，可用于鉴别。黄酮的显色反应：黄酮类化合物的显色反应多与分子中的酚羟基及γ-吡喃酮环有关。1.还原试验：（1）盐酸-镁粉（或锌粉）反应；（2）四氢硼钠（钾）反应；2.金属盐类试剂的络合反应：（1）铝盐；（2）铅盐；（3）锆盐；（4）镁盐；（5）氯化锶；（6）三氯化铁；3.硼酸显色反应；4.碱性试剂显色反应。皂苷（D错）能发生显色反应，可用于鉴别。皂苷的显色反应：（1）Liebermann反应；（2）醋酐-浓硫酸反应；（3）三氯乙酸反应；（4）五氯化锑反应；（5）芳香醛-硫酸或高氯酸反应。生物碱（E错）能发生沉淀反应和显色反应，可用于鉴别。大多数生物碱在酸水或稀醇中与某些试剂反应生成难溶于水的络合物或复盐，这一反应称为生物碱沉淀反应，这些试剂称为生物碱沉淀试剂。常用的生物碱沉淀试剂有碘化铋钾试剂、碘化汞钾试剂、碘-碘化钾试剂、硅钨酸试剂、饱和苦味酸试剂、雷氏铵盐试剂等。某些生物碱能与一些试剂反应生成不同颜色的产物，这些试剂称为生物碱显色剂。生物碱显色试剂较多，常用的显色剂有Mandelin试剂（1%钒酸铵的浓硫酸溶液）、Macquis试剂（含少量甲醛的浓硫酸）、Frohde试剂（1%钼酸钠或钼酸铵的浓硫酸溶液）。